“妇人之生，有余于气，不足于血，以其数脱于血也”是对女性何种特点的概括
A. 疾病特点
B. 体质特点
C. 情志特点
D. 性格特点
E. 病机特点

正确答案：B。体质特点

解析：此句出自《灵枢·五音五味第六十五》“黄帝曰：妇人无须者，无血气乎？岐伯曰：冲脉任脉皆起于胞中，上循背里，为经络之海，其浮而外者，循腹上行，会于咽喉，别而络唇口，血气盛则充肤热肉，血独盛者澹渗皮肤，生毫毛。今妇人之生有余于气，不足于血以其数脱血也，冲任之脉，不荣口唇，故须不生焉。”这句话的意思是妇女由于月经、怀孕、生产、哺乳等生理特点，需要消耗较多的血，所以就整个机体而言，气总是相对地偏盛，而血总是相对地不足的。故这句话概括了女性的体质特点（B对）。